男性，22岁。右膝内侧肿块5年，生长缓慢，无明显疼痛。X线片显示股骨下端内侧干骺端杵状肿块，边缘清楚。应首先考虑的是
A. 骨肉瘤
B. 骨巨细胞瘤
C. 软骨肉瘤
D. 骨软骨瘤
E. 骨样骨瘤

正确答案：D。骨软骨瘤

解析：青年男性患者，右膝内侧肿块生长缓慢、无明显疼痛（提示肿块为良性），X线片示股骨下端内侧干骺端杵状肿块，边缘清楚（骨软骨瘤典型影像学表现），结合患者的症状和影像学表现，应首先考虑的是右股骨骨软骨瘤（D对）。骨肉瘤（A错）为恶性骨肿瘤，X线片可见Codman三角或“日光射线”形态，肿瘤边界不清。骨巨细胞瘤（B错）为交界性肿瘤，X线片可见骨端偏心性、溶骨性、囊性破坏而无骨膜反应。软骨肉瘤（C错）是恶性骨肿瘤， X线片可有云雾状改变，边界不清。骨样骨瘤（E错）主要症状是疼痛，进行性加重，多数患者服用阿司匹林可缓解症状。